急性心肌梗死时最易引起房室传导阻滞的梗死部位是
A. 前壁
B. 下壁
C. 侧壁
D. 后壁
E. 广泛前壁

正确答案：B。下壁